划分社会阶层的主要依据是
A. 文化水平
B. 经济地位
C. 价值观念
D. 生活条件
E. 职业

正确答案：B。经济地位